静脉注射阿昔洛韦的适宜溶媒是
A. 0.9%氯化钠注射液
B. 5%葡萄糖注射液
C. 50%葡萄糖注射液
D. 复方氯化钠注射液
E. 低分子右旋糖酐注射液

正确答案：A。0.9%氯化钠注射液

解析：本题考查药物的适宜溶剂。静脉注射阿昔洛韦的适宜溶媒是0.9%的氯化钠注射液（A对）。阿昔洛韦与5%葡萄糖注射液（B错）配伍可析出沉淀。50%葡萄糖注射液（C错）主要用于组织脱水。复方氯化钠注射液（D错）为复方制剂，不适宜作为溶解的溶媒。低分子量右旋糖酐注射液（E错）主要用于提高血液的胶体渗透压而扩充血容量。